AB血型人的红细胞膜上和血清中分别含
A. A凝集原和抗A、抗B凝集素
B. B凝集原和抗B凝集素
C. A凝集原和抗B凝集素
D. B凝集原和抗A凝集素
E. A、B凝集原，不含抗A抗B凝集素

正确答案：E。A、B凝集原，不含抗A抗B凝集素

解析：红细胞表面凝集原本质是抗原，血清中凝集素的本质是抗体，不同血型的人的血清中含有不同的抗体，但不含与自身红细胞抗原相对应的抗体，以免发生抗原-抗体反应引起红细胞凝集。AB型血型的人红细胞膜含有A与B两种凝集原，所以血清中不含抗A抗B凝集素（E对）。A凝集原和抗B凝集素（C错）存在于A型血的人红细胞膜上和血清中。B凝集原和抗A凝集素（D错）存在于B型血的人红细胞膜上和血清中。